治疗温热病后，神倦瘛疭，舌绛少苔，脉细弱，应首选
A. 镇肝熄风汤
B. 天麻钩藤饮
C. 羚角钩藤汤
D. 大定风珠
E. 地黄饮子

正确答案：D。大定风珠

解析：大定风珠证系由温病迁延日久，邪热灼伤真阴所致。肝为风木之脏，阴液大亏，水不涵木，虚风内动，而见手足瘈疭；真阴欲竭，故见神倦乏力、舌绛少苔、脉细弱。本证邪热已去八九，真阴仅存一二，故治宜味厚滋补之品，滋阴养液，填补欲竭之真阴，平息内动之虚风，用大定风珠治疗（D对）。镇肝熄风汤（A错）的功用为镇肝息风，滋阴潜阳，主治类中风。天麻钩藤饮（B错）主治肝阳偏亢，肝风上扰证。羚角钩藤汤（C错）的功用为凉肝息风，增液舒筋，主治肝热生风证。地黄饮子（E错）的功用为滋肾阴，补肾阳，开窍化痰，主治喑痱。